组织学生与家长共同参与知识竞赛，属于
A. 学校健康教育
B. 学校卫生服务
C. 学校健康政策
D. 学校事物环境
E. 学校健康物质环境

正确答案：A。学校健康教育